医疗事故技术鉴定书中不包括
A. 医疗事故等级
B. 医疗事故所需赔偿的金额
C. 双方当事人的基本情况及要求
D. 对医疗事故患者的医疗护理医学建议
E. 医疗过失行为在医疗事故损害后果中的责任程度

正确答案：B。医疗事故所需赔偿的金额

解析：医疗事故技术鉴定书应当包括下列主要内容：①双方当事人的基本情况及要求；②当事人提交的材料和负责组织医疗事故技术鉴定工作的医学会的调查材料；③对鉴定过程的说明；④医疗行为是否违反医疗卫生管理法律、行政法规、部门规章和诊疗护理规范、常规；⑤医疗过失行为与人身损害后果之间是否存在因果关系；⑥医疗过失行为在医疗事故损害后果中的责任程度；⑦医疗事故等级；⑧对医疗事故患者的医疗护理医学建议。掌握“医疗事故的技术鉴定”知识点。